旋覆花具有的功效是
A. 温肺
B. 降气
C. 利尿
D. 除湿
E. 渗湿

正确答案：B。降气

解析：旋覆花苦泄辛散，微温而降，主入肺、胃经，兼入脾与大肠经。既下气行水消痰，又降胃气止呕哕，为治肺胃气逆之要药（B对）。有温肺（A错）功效的中药有白芥子、细辛、干姜等。有利尿（C错）功效的中药有浮萍、芦根、竹叶、车前子、滑石、木通等。有除湿（D错）功效的中药有羌活、蒿本、独活、川乌等。有渗湿（E错）功效的中药有茯苓、薏苡仁等。